女，35岁，初产妇，妊娠34+1周，头痛1天。查体：BP170/110mmHg，胎心率150次/分，胎儿大小相当于32周，羊水深度2.0cm，尿蛋白（+++）。该患者正确的处理原则是
A. 解痉降压后羊膜腔内药物引产
B. 硫酸镁解痉后剖宫产
C. 降压治疗后继续妊娠
D. 对症处理继续妊娠
E. 降压的同时宫缩素引产

正确答案：B。硫酸镁解痉后剖宫产

解析：患者女，35岁，初产妇。妊娠34+1周，头痛1天（符合颅内高压主要临床表现）。查体：BP170/110mmHg，胎心率150次/分，胎儿大小相当于32周，羊水深度2.0cm（提示羊水过少）。尿蛋白（+++）（提示肾功能不全）。综上所述，该患者初步诊断为子痫前期，且羊水过少，胎儿有宫内窒息危险，应立即终止妊娠，故该患者正确的处理原则是硫酸镁解痉后剖宫产（B对）。因患儿有宫内窘迫危险，预估短时间不能结束分娩，故不应选择阴道试产及引产，故解痉降压后羊膜腔内药物引产（A错）和降压的同时缩宫素引产（E错）均不正确。该患者羊水过少，胎儿储备下降，有宫内窘迫风险，不能降压治疗后继续妊娠（C错），也不能对症处理继续妊娠（D错）。